肺炎链球菌的主要致病物质除外的是
A. 荚膜
B. 菌毛
C. 紫癜形成因子
D. 神经氨酸酶
E. 肺炎链球菌溶血素

正确答案：B。菌毛

解析：肺炎链球菌的主要致病物质：①荚膜：是主要的毒力因子，具有抗吞噬作用。有荚膜的肺炎链球菌的抵抗力强。②肺炎链球菌溶血素（或称肺炎链球菌溶素）：可溶解人、马、羊和兔的红细胞，并能活化补体经典途径，引起发热、炎症及组织损伤。③神经氨酸酶：与肺炎链球菌在鼻咽部和支气管黏膜的定植、繁殖及扩散有关。④脂磷壁酸：存在于细胞壁表面，在肺炎链球菌黏附到肺上皮细胞或血管内皮表面时起重要作用。掌握“链球菌属”知识点。